24岁男性，农民。因畏寒发热起病，伴全身肌肉酸痛，头痛4天，于8月10日入院。入院1天发现皮肤黄染，尿量减少，尿色深黄，查体：结膜充血，巩膜及皮肤中度黄染，皮肤有出血点，浅表淋巴结肿大，肝肋下lcm，压痛（+），脾（-），实验室检查WBC15.4×10⁹/L，N80%，L20%，尿检：尿蛋白（+），颗粒管型，WBC8～15/HP，RBC20～30/HP，BUN24mmol/L，凝集溶解试验阳性。最大可能的诊断是
A. 急性黄疸型肝炎
B. 肾综合征出血热
C. 伤寒溶血尿毒综合征
D. 黑尿病
E. 钩端螺旋体病

正确答案：E。钩端螺旋体病

解析：患者起病出现早期中毒综合征，有“三症状”，即畏寒发热、肌肉酸痛、全身乏力，结合眼结膜充血、淋巴结肿大、肝大，凝集溶解试验阳性等体征和实验室检查，应诊断为钩端螺旋体病（E对）。急性黄疸型肝炎（P28）（A错）无全身肌肉酸痛，浅表淋巴结少有肿大。肾综合征出血热（P77）（B错）很少出现黄疸。溶血尿毒综合征，是一类原因不明的急性血管内溶血性贫血伴肾功能衰竭的综合征，常伴黑便呕血，伤寒溶血尿毒综合征（C错）十分少见。黑尿病（D错）是由于缺乏尿黑酸氧化酶，使尿液呈黑色。